女，25岁。宫颈管分泌物涂片见中性粒细胞内有革兰阴性双球菌首选的治疗药物是
A. 多西环素
B. 青霉素
C. 红霉素
D. 头孢曲松
E. 阿奇霉素

正确答案：D。头孢曲松

解析：25岁青年女性，宫颈管分泌物涂片提示中性粒细胞内有革兰阴性双球菌，提示患者患有淋病，治疗淋病推荐联合使用头孢菌素和阿奇霉素（D对），首选头孢曲松钠250mg。多西环素常用于治疗沙眼衣原体或支原体引起的感染（A错）。青霉素常用于治疗梅毒的首选治疗用药（B错）。0.5% 红霉素眼膏可用于预防淋病产妇分挽的新生儿淋菌性眼炎，也可以用于青霉素过敏的梅毒患者的治疗（C错）。阿奇霉素可用于淋病患者单次肌内注射的患者，是妊娠期感染沙眼衣原体首选用药（E错）。